以下哪个解剖结构不位于下颌骨体部外侧面
A. 外斜线
B. 颏孔
C. 正中联合
D. 颏棘
E. 颏结节

正确答案：D。颏棘

解析：下颌体：外侧面中线处有正中联合；正中联合两旁有左右各一的颏结节；从颏结节向后上延至下颌支前缘的骨嵴，称为外斜线，有降下唇肌及降口角肌附着；在外斜线上方，下颌第二前磨牙的下方或第一、第二前磨牙之间的下方，下颌体上、下缘之间略偏上处有颏孔。其内侧面近中线处有两对突起，上颏棘和下颏棘。掌握“下颌骨及腭骨解剖特点”知识点。